卫生桥体龈面与牙槽嵴黏膜之间的间隙至少为几毫米以上
A. 2mm
B. 2.5mm
C. 3mm
D. 3.5mm
E. 4mm

正确答案：C。3mm

解析：悬空式桥体：桥体与牙槽嵴顶的黏膜不接触，留有至少3mm以上的间隙，此间隙便于食物通过而不积聚，自洁作用良好，故称为卫生桥。掌握“固定桥的设计”知识点。